深龋引起的可复性牙髓炎，采用间接盖髓术时，常使用的盖髓剂是
A. 氢氧化钙
B. 磷酸锌黏固粉
C. 玻璃离子黏固粉
D. 氧化锌丁香油黏固粉
E. 碘仿糊剂

正确答案：A。氢氧化钙

解析：本题考查盖髓剂。氢氧化钙呈弱碱性，可中和炎症产生的酸性产物，有利于消除炎症和减轻疼痛，氢氧化钙在形成牙本质桥的过程中还可作为一种诱导剂，激活成牙本质细胞碱性磷酸酶而促进硬组织的形成，而且氢氧化钙还有一定的灭菌作用（A对）。磷酸锌黏固粉在粘结的过程中释放游离酸，不适于深龋的患者，刺激牙髓（B错）。氧化锌丁香油黏固粉具有安抚的作用，不能作为永久充填的盖髓剂（D错）。碘仿糊剂可促进根尖部炎症消退，不是盖髓剂（E错）。